泻肺中伏火清肺热的方剂是
A. 玉女煎
B. 清胃散
C. 苇茎汤
D. 泻白散
E. 龙胆泻肝汤

正确答案：D。泻白散

解析：泻肺中伏火清肺热的方剂是泻白散。主治肺热喘咳证，为治疗肺热喘咳的常用方（D对）。玉女煎属清润之剂，功能清胃火、滋肾阴，主治胃火旺而肾水不足的牙痛及牙宣诸症（A错）。清胃散清胃凉血，以使上炎之火得降，血分之热得除，于是循经外发诸症皆可因热毒内彻而解（B错）。苇茎汤不论肺痈之将成或已成皆可使用。用于肺痈脓未成者，服之可使消散；脓已成者，可使肺热清，痰瘀化，脓液外排，痈渐向愈（C错）。龙胆泻肝汤的配伍特点是泻中有补，利中有滋，降中寓升，祛邪而不伤正，泻火而不伐胃，从而火降热清，湿浊得利，循经所发诸症可相应而愈（E错）。